一患者因儿童时期颏部外伤所致双侧颞下颌关节强直，需手术治疗，因病人无法耐受同期双侧手术，而需2次手术，两次手术之间的间隔不应超过
A. 3天
B. 1周
C. 2周
D. 1个月
E. 3个月

正确答案：C。2周

解析：本题考查双侧颞下颌关节强直两次手术之间的间隔。双侧关节内强直最好一次手术，以便术后能及时行开口练习；如必须分两次手术，相隔时间亦不应超过2周（C对），以免第一次手术处发生瘢痕挛缩。